在体内以辅酶的形式参与氨基酸代谢的维生素是
A. 维生素B₁
B. 维生素E
C. 维生素B₆
D. 维生素C
E. 叶酸

正确答案：C。维生素B₆

解析：本题考查维生素B₆。维生素B₆（C对）在红细胞内转化为磷酸吡哆醛，后者作为人体不可缺乏的辅酶，可参与氨基酸、碳水化合物及脂肪的正常代谢。维生素B₁（A错）主要用于维生素B₁缺乏症，如神经炎、中枢神经系统损伤等。维生素E（B错）用于习惯性流产及不孕症的辅助治疗。维生素C（D错）用于抗坏血酸。叶酸（E错）用于治疗巨幼红细胞性贫血、血小板减少症。